克雷伯杆菌引起的尿路感染，有临床诊断意义的最低菌落计数为
A. 清洁中段尿培养，菌落计数为＜1000个/ml
B. 清洁中段尿培养，菌落计数为1000个/ml
C. 清洁中段尿培养，菌落计数为1万个/ml
D. 清洁中段尿培养，菌落计数为5万个/ml
E. 清洁中段尿培养，菌落计数为10万个/ml

正确答案：A。清洁中段尿培养，菌落计数为＜1000个/ml

解析：一般情况下，取清洁中段尿、导尿或膀胱穿刺尿做细菌培养，菌落多于10万/ml，可确诊尿路感染；少于1万/ml，认为可能为污染，应重复培养；1万/ml到10万/ml之间为可疑阳性。但是克雷伯杆菌繁殖缓慢，致病性较强，只要尿中出现，即有诊断意义（A对）。